治疗陈旧性宫外孕，应首选
A. 宫外孕Ⅰ号方
B. 膈下逐瘀汤
C. 血府逐瘀汤
D. 理冲丸
E. 桂枝茯苓丸

正确答案：D。理冲丸

解析：陈旧性宫外孕是指输卵管妊娠破裂或流产后，如为反复少量出血，腹腔内积血可形成血肿，被周围及肠管包裹，可形成血肿，日久血肿机化变硬并与周围组织粘连，可形成盆腔包块，称为陈旧性宫外孕”。“包块型——瘀结成癥证（陈旧性异位妊娠）证侯：输卵管妊娠破裂日久…舌质暗苔薄白，脉弦细或涩。治法：活血化瘀，消癥散结。方药：理冲丸。”（D对）。宫外孕I号方（A错）用于已破损期，指输卵管妊娠流产或破裂者，功效在于益气化瘀，消徽杀胚。膈下逐淤汤（B错）功效为活血祛瘀，行气止痛，可用于宫外孕、不孕症等属血瘀气滞者。血府逐瘀汤（C错）用于瘀热蓄于下焦，少腹急结，大便色黑，小便自利，甚则谵语烦渴，其人如狂，至夜发热，及血瘀经闭、痛经。桂枝茯苓丸（E错）为理血剂，具有活血、化瘀、消症之功效，主治妇人宿有症块，或血瘀经闭，行经腹痛，产后恶露不尽。